原发性慢性肾上腺皮质功能减退症的症状是由于缺乏
A. 促肾上腺皮质激素
B. 醛固酮
C. 皮质醇
D. 醛固酮及皮质醇
E. 肾上腺素及去甲肾上腺素

正确答案：D。醛固酮及皮质醇

解析：原发性慢性肾上腺皮质功能减退症是由于双侧肾上腺的绝大部分被毁所致，本病肾上腺皮质全层毁坏包括球状带（主要含有分泌醛固酮的细胞）、束状带（主要含有分泌皮质醇的细胞）被毁，导致醛固酮和皮质醇（D对）分泌不足。皮质醇和醛固酮缺乏引起多系统症状和代谢紊乱等临床表现。促肾上腺皮质激素（A错）分泌减少见于继发于下丘脑-垂体病变引起的慢性肾上腺功能减退症。肾上腺素及去甲肾上腺素（E错）为肾上腺髓质产生，原发性肾上腺皮质功能减退症的肾上腺皮质受破坏，髓质影响不大，故肾上腺素及去甲肾上腺素分泌无明显变化。